大便溏结不调，其临床意义是
A. 胃肠积热
B. 湿热蕴脾
C. 气血淤滞
D. 肝郁脾虚
E. 食滞胃肠

正确答案：D。肝郁脾虚

解析：肝郁脾虚 由于肝失疏泄，经气郁滞，气滞湿阻，则肠鸣矢气，便溏不爽，或溏结不调（D对）。胃肠积热（A错）、湿热蕴结（B错）、气血瘀滞（C错）会出现便血。湿热食滞胃肠则会出现完谷不化、大便酸腐臭秽（E错）。